DNA复制方式为
A. 完全复制
B. 二分裂复制
C. 半保留复制
D. 半数有效复制
E. 相似保留复制

正确答案：C。半保留复制

解析：DNA复制为半保留复制方式，使子代细胞得到和亲代相一致的遗传物质，使复制具有高保真性。掌握“概述及DNA的生物合成”知识点。